呃逆表示
A. 心气不足
B. 肝气郁结
C. 脾气下陷
D. 胃气上逆
E. 肺气上逆

正确答案：D。胃气上逆

解析：呃逆指从咽喉发出的一种不由自主的冲击声，呃呃作响，声短而频，不能自制的症状。俗称“打呃”，唐代以前称“哕”，是胃气上逆的表现。（D对）。心气不足（A错）可见独语、错语。肝气郁结（B错）可见太息。脾气下陷（C错）可见泄泻。肺气上逆（E错）可见咳嗽。